使相应细菌裂解的噬菌体称为
A. 温和噬菌体
B. 毒性噬菌体
C. 前噬菌体
D. 溶原性细菌
E. L型细菌

正确答案：B。毒性噬菌体